硼砂外用能清热解毒，内服能
A. 消积
B. 清肺化痰
C. 补火助阳通便
D. 止痢
E. 散结消肿

正确答案：B。清肺化痰

解析：本题考查硼砂的功效。硼砂外用能清热解毒，内服能清肺化痰（B对）。硼砂【功效】外用清热解毒，内服清肺化痰。厚朴【功效】燥湿，行气，消积（A错），平喘。硫黄【功效】外用解毒杀虫止痒，内服补火助阳通便（C错）。仙鹤草【功效】收敛止血，止痢（D错），截疟，解毒，杀虫，补虚。夏枯草【功效】清肝明目，散结消肿（E错）。